根头部略膨大，有密集的呈疣状突起的芽孢、茎或根茎的残基，习称“珍珠盘”的药材是
A. 银柴胡
B. 威灵仙
C. 徐长卿
D. 北豆根
E. 狗脊

正确答案：A。银柴胡

解析：本题考查的是银柴胡药材的性状鉴别。根头部略膨大，有密集的呈疣状突起的芽孢、茎或根茎的残基，习称“珍珠盘”的药材是银柴胡（A对）。银柴胡：【性状鉴别】药材呈类圆柱形，偶有分枝。表面浅棕黄色至浅棕色，有扭曲的纵皱纹及支根痕，多具孔穴状或盘状凹陷，习称“砂眼”，从砂眼处折断可见棕色裂隙中有细砂散出。根头部略膨大，有密集的呈疣状突起的芽苞、茎或根茎的残基，习称“珍珠盘”。质硬而脆，易折断，断面不平坦，较疏松，有裂隙，皮部甚薄，木部有黄、白色相间的放射状纹理。气微，味甘。威灵仙（B错）：【性状鉴别】药材根茎呈柱状；表面淡棕黄色；顶端残留茎基；质较坚韧，断面纤维性；下侧着生多数细根。根呈细长圆柱形，稍弯曲；表面黑褐色，有细纵纹，有的皮部脱落，露出黄白色木部；质硬脆，易折断，断面皮部较广，木部淡黄色，略呈方形，皮部与木部常有裂隙。气微，味淡。徐长卿（C错）：【性状鉴别】药材根茎呈不规则柱状，有盘节。有的顶端带有残茎，细圆柱形，断面中空；根茎节处周围着生多数细长的根。根呈细长圆柱形，弯曲。表面淡黄白色至淡棕黄色或棕色；具微细的纵皱纹，并有纤细的须根。质脆，易折断，断面粉性，切断面皮部类白色或黄白色，形成层环淡棕色，木部细小。气香（含丹皮酚），味微辛凉。北豆根（D错）：【性状鉴别】药材呈细长圆柱形，弯曲，有分枝。表面黄棕色至暗棕色，多有弯曲的细根，并可见突起的根痕和纵皱纹，外皮易剥落。质韧，不易折断，断面不整齐，纤维细，木部淡黄色，呈放射状排列，中心有髓。气微，味苦。狗脊（E错）：【性状鉴别】药材呈不规则的长块状。表面深棕色，残留金黄色绒毛，上面有数个红棕色的木质叶柄，下面残存黑色细根。质坚硬，不易折断。无臭，味淡、微涩。